与医学有关的细胞质内的亚结构不包括
A. 核质
B. 质粒
C. 核糖体
D. 肽聚糖
E. 胞质颗粒

正确答案：D。肽聚糖

解析：与医学有关的细胞质内的亚结构主要有核质、核糖体、质粒及胞质颗粒。掌握“细菌的大小、形态和基本结构”知识点。